从病因推论的角度来看，随机对照试验的系统综述在设计和分析的要素中未直接涉及
A. 时间顺序
B. 关联强度
C. 生物学合理性
D. 实验证据
E. 结果的一致性

正确答案：C。生物学合理性

解析：本题考查系统综述的相关内容。从病因推论的角度来看，随机对照试验的系统综述在设计和分析的要素中包含了希尔的主要准则，如时间顺序（A对）、关联强度（B对）、剂量反应关系、实验证据（D对）、一致性（E对）等，并未直接涉及生物学合理性（C错，为本题正确答案）。